有人对某地区250例胃癌患者进行流行病学调查，包括人口学资料、饮酒、吸烟、劳动强度、吃变硬或发霉的馒头、膳食中蔬菜和蛋白质的量以及情绪变化等，同时对条件与上述250例在性别、年龄近似的400名当地的非胃癌患者（或健康人）进行同样项目的调查，以便进行结果比较。在该项科研工作中使用了哪种流行病学研究方法
A. 现况研究
B. 筛查
C. 病例对照研究
D. 队列研究
E. 流行病学实验研究

正确答案：C。病例对照研究